患者男性，63岁，颊癌术后7年，术后曾行颈部及颌下区放疗，剂量不详。3个月前行出现下颌牙龈溃疡，经久未愈且局部骨外露伴下颌区域针刺剧痛。此患者可能的诊断放射性颌骨坏死,为对此患者疾病治疗有意义的方法是高压氧治疗,此患者如进行手术治疗应选择的术式为
A. 待死骨分离后摘除死骨
B. 行骨髓炎刮治术
C. 三叉神经撕脱术
D. 在死骨边缘的正常骨内行死骨切除
E. 局部方块切除

正确答案：D。在死骨边缘的正常骨内行死骨切除

解析：本题考查放射性骨髓炎的治疗。目前认为确诊放射性骨髓炎者，不必待死骨完全分离，应在健康骨质范围内施行死骨切除术，可收到预防病变扩大的结果（D对）。慢性颌骨骨髓炎病灶清除以摘除死骨为主，死骨分离后施行手术效果最好（A错）。三叉神经撕脱术用于三叉神经痛的治疗（C错）。